不属于硝酸甘油的药理作用机制的是
A. 降低室壁肌张力
B. 降低心肌耗氧量
C. 扩张心外膜血管
D. 降低左心室舒张末压
E. 降低交感神经活性

正确答案：E。降低交感神经活性

解析：硝酸甘油是常用的抗心绞痛药物，基本药理作用是松弛平滑肌，但具有组织器官的选择性，以对血管平滑肌的作用最显著。小剂量的的硝酸甘油就可以明显扩张静脉血管，从而减少回心血量，降低心脏的前负荷，使心室容积缩小，心室内压减小（D对），心室壁张力降低（A对），射血时间缩短，心肌耗氧量减少（B对）。并且硝酸甘油还可以选择性扩张较大的心外膜血管（C对）、输送血管及侧支血管，尤其是在冠状动脉痉挛时更为明显，对阻力血管的舒张作用较弱。大剂量的硝酸甘油在扩张血管的同时，可反射性兴奋交感神经（E错，为本题正确答案），使心肌收缩力增加，心率加快，心肌耗氧量增加。